染色质的基本组成单位是
A. 核小体
B. 核大体
C. 超螺旋
D. DNA双链
E. 染色质纤维

正确答案：A。核小体

解析：核小体是染色质的基本组成单位。许多核小体连接成串珠状，再经过反复盘旋折叠最后形成染色单体。掌握“DNA”知识点。